肾功能不全的患者可选用
A. 肝肠循环
B. 肾毒性小肝代谢的药物
C. 肝毒性小肾代谢的药物
D. 肝肾双通道排泄的药物
E. 首关消除的药物

正确答案：D。肝肾双通道排泄的药物

解析：本题考查肾功能不全患者用药。肾功能不全而肝功能正常者可选用肝肾双通道排泄的药物（D对）。肾功能不全患者用药原则：1.明确诊断，合理选药。2.避免或减少使用肾毒性大的药物。3.注意药物相互作用，特别应避免与具有肾毒性的药物合用。4.肾功能不全而肝功能正常者可选用经双通道（肝、肾）消除的药物。5.根据肾功能的情况调整用药剂量和给药间隔时间，必要时进行治疗药物监测，设计个体化给药方案。